与病理缩复环关系最密切的是
A. 嵌顿性肩先露
B. 重度妊高征
C. 中央性前置胎盘
D. 重型胎盘早剥
E. 双胎妊娠

正确答案：A。嵌顿性肩先露

解析：嵌顿性肩先露使子宫收缩继续增强，子宫上段越来越厚，子宫下段被动扩张越来越薄，由于子宫上下段肌壁厚薄相差悬殊，形成环状凹陷，并随宫缩逐渐升高，甚至可以高达脐上，形成病理缩复环。故与病理缩复环关系最密切的是嵌顿性肩先露（A对）。